因抢救危急患者未能及时书写病历的，有关医务人员应在抢救结束后多少小时内据实补记，并加以注明
A. 2小时
B. 4小时
C. 8小时
D. 6小时
E. 10小时

正确答案：D。6小时

解析：《医疗事故处理条例》规定，因抢救急危患者，未能及时书写病历的，有关医务人员应当在抢救结束后6个小时（D对）内据实补记，并加以注明。